产地加工时，需要“发汗”的药材是
A. 秦皮
B. 肉桂
C. 地骨皮
D. 厚朴
E. 黄柏

正确答案：D。厚朴

解析：本题考查的是厚朴的产地加工。产地加工时，需要“发汗”的药材是厚朴（D对）。厚朴：【采收加工】4～6月剥取，干皮置沸水中微煮后，经“发汗”处理至内表面变紫褐色或棕褐色时，再蒸软，取出，卷成筒状，干燥。枝皮及根皮直接阴干。秦皮（A错）：【采收加工】春、秋二季剥取枝皮或干皮，晒干。肉桂（B错）：【采收加工】每年分两期采收，第一期于4～5月间，第二期于9～10月间，以第二期产量大，香气浓，质量佳。采收时选取适龄肉桂树，按一定的长度、阔度剥下树皮，放于阴凉处，按各种规格修整，或置于木质的“桂夹”内压制成型，阴干或先放置阴凉处2～3天后，于弱光下晒干。地骨皮（C错）：【采收加工】春初或秋后采挖根部，洗净，剥取根皮，晒干。黄柏（E错）：【采收加工】3～6月间采收，选10年左右的树，剥取树皮后，除去粗皮，晒干。